麻醉药品连续使用后易产生瘾癖以及
A. 精神依赖性
B. 身体依赖性
C. 兴奋性
D. 抑制性
E. 二重性

正确答案：B。身体依赖性

解析：本题考查麻醉药品。麻醉药品是指连续使用后易产生身体依赖性（B对）、能成瘾癖的药品。只限于医疗、教学和科研需要，其他一律不得使用。